菌痢假膜形成属
A. 蜂窝织炎
B. 脓肿
C. 卡他性炎
D. 纤维素性炎
E. 积脓

正确答案：D。纤维素性炎

解析：细菌性痢疾简称菌痢，是由痢疾杆菌所引起的一种假膜性肠炎，病变多局限于结肠，以大量纤维素渗出形成假膜为特征，属纤维素性炎（D对）。蜂窝织炎（A错）主要由溶血性链球菌引起，常发生于疏松结缔组织中。脓肿（B错）主要由金黄色葡萄球菌引起，主要发生于皮下和内脏。卡他性炎（C错）以浆液渗出为特征。积脓（E错）指化脓性炎发生于浆膜、胆囊和输卵管并在其管腔中积存。